髋关节脱位常见的方位是
A. 前方
B. 上方
C. 内侧
D. 外侧
E. 后下方

正确答案：E。后下方

解析：髋关节关节囊周围有多条韧带加强，但是囊的后下部（E对）较为薄弱，股骨头易由此脱出。